唇腭裂患儿要达到较满意的形态和功能效果，需进行序列治疗，一般包括
A. 心理治疗
B. 耳科治疗
C. 语音治疗
D. 唇、腭裂二期整复术
E. 以上均包括

正确答案：E。以上均包括

解析：序列治疗的步骤：①新生儿正畸治疗②唇裂修复③腭裂修复④术后语音的效果的观察和治疗⑤乳牙期和替牙期正畸治疗⑥牙槽突植骨术⑦外科正畸治疗⑧矫形修复治疗⑨唇腭裂二期修复⑩耳科治疗?心理治疗。掌握“唇腭裂的序列治疗”知识点。